复元活血汤的功效是
A. 补血活血，化瘀生新
B. 活血化瘀，消肿止痛
C. 祛瘀活血，续筋接骨
D. 活血逐瘀，疏肝通络
E. 攻下淤血，荡涤胃肠

正确答案：D。活血逐瘀，疏肝通络

解析：复元活血汤方中含桃仁、红花、当归、大黄、瓜蒌根，主要用于活血逐瘀；炮穿山甲、柴胡，以活血逐瘀，疏肝通络（D对），主治跌打损伤，瘀血阻滞证。胁肋瘀肿，痛不可忍。